女，40岁。确诊为急性胰腺炎，内科正规治疗2周后上腹部压痛明显。体温仍在38℃-39℃，血淀粉酶256U/L，血WBC16×10⁹/L。可能性最大的是
A. 败血症
B. 病情迁延未愈
C. 合并急性胆囊炎
D. 并发胰腺假性囊肿
E. 并发胰腺脓肿

正确答案：E。并发胰腺脓肿

解析：患者确诊急性胰腺炎，保守治疗2周后上腹部压痛明显。体温38℃-39℃，血淀粉酶256U/L，血WBC16×10⁹/L，考虑急性胰腺炎并发胰腺脓肿。胰腺感染通常发生在急性胰腺炎发作2周后，表现为体温＞38.5℃，白细胞计数＞16×10⁹/L等感染症状，诊断胰腺脓肿（E对）。败血症（A错）常表现为全身中毒症状，伴随神志改变，出现皮疹等。急性胰腺炎病情迁延不愈将发展为慢性胰腺炎（B错），表现为反复发作性或持续性腹痛、腹泻或脂肪泻、消瘦、黄疸、腹部包块和糖尿病。急性胆囊炎（C错）常表现为右上腹阵发性疼痛，Murphy征阳性。胰腺假性囊肿（D错）是含有胰内瘘的渗出液积聚，常难以吸收，由纤维组织增生形成囊壁，包裹而成胰腺假性囊肿。囊肿＜5cm时，6周内约50%可自行吸收；囊肿大时，可有明显腹胀及上、中消化道梗阻等症状。